有关肝脏的说法中不正确的是
A. 是体内最大的腺体
B. 约占与体重的2.5%
C. 人体最大的实质性器官
D. 不具有生物化学功能
E. 具有分泌和排泄的生理功能

正确答案：D。不具有生物化学功能

解析：肝是人体最大的实质性器官。也是体内最大的腺体，成人肝组织约重1500g，约占体重的2.5%。其独特的形态组织结构和化学组成特点，赋予肝复杂多样的生物化学功能。肝不仅在机体糖、脂类、蛋白质、维生素、激素等物质代谢中处于中心地位，而且肝还具有生物转化、分泌和排泄等方面的生理功能。掌握“肝的生物转化”知识点。